诊断子宫内膜癌最可靠的方法是
A. 细胞学检查
B. B超检查
C. 子宫镜检查
D. 分段诊刮
E. 淋巴造影

正确答案：D。分段诊刮

解析：诊断子宫内膜癌最可靠的方法是分段诊刮（D对）。如果临床或影像学检查怀疑子宫内膜癌，应行分段诊刮，明确诊断。细胞学涂片（P404）（A错）适用于恶性肿瘤的初步筛选，不作为确诊依据。B超检查（P315）（B错）可了解子宫大小、宫腔形状、宫腔内有无赘生物、子宫内膜厚度、肌层有无浸润及深度，可对异常阴道流血的原因作出初步判断并为进一步的检查选择提供参考，不作为确诊手段。子宫镜检查（P316）（C错）可直视癌灶取材活检，对局灶型子宫内膜癌的诊断更为准确，可用于刮宫阴性，但高度怀疑子宫内膜癌者。淋巴造影（E错）主要用于了解盆腔及主动脉旁淋巴结有无转移。